患者咳嗽痰多，痰白清稀，食少便溏近日下肢轻度浮肿，舌淡苔白，脉弱。治疗应选用
A. 党参
B. 薏苡仁
C. 山药
D. 白术
E. 黄精

正确答案：D。白术

解析：患者咳嗽痰多，痰白清稀，食少便溏，下肢轻度浮肿，舌淡苔白，脉弱，为脾气不足，运化失健引起，治以健脾补气，燥湿利水。白术具有益气健脾，燥湿利水，止汗，安胎的功效，被誉为“脾脏补气健脾第一要药”（D对）。党参具有补脾肺气，补血，生津的功效，以补脾肺之气为主要作用，没有燥湿利水的功效（A错）。薏苡仁具有利水渗湿，健脾，除痹，清热排脓的功效，常用于脾虚湿盛之水肿腹胀，小便不利，利水之功较白术弱（B错），山药具有益气养阴，补脾肺肾，固精止带的功效，能补脾益气，滋养脾阴，用于脾气虚弱或气阴两虚证，没有燥湿利水的功效（C错）。黄精具有补气养阴，健脾，润肺，益肾的功效，主治脾胃气虚、倦怠乏力、食欲不振、脉象虚软者，没有燥湿利水的功效（E错）。